三焦中“中焦”包括哪些脏腑
A. 脾胃
B. 肝肾
C. 心肾
D. 肺脾
E. 心肺

正确答案：A。脾胃

解析：该题考查部位三焦。横膈以上的部位，包括心、肺两脏，以及头面部，归属上焦（CDE错）；横膈以下、脐以上的部位，包括脾胃小肠、肝胆等脏腑，归属中焦（A对）；脐以下的部位为下焦，包括肾、大肠、膀胱、女子胞、精室等脏腑，归属下焦（B错）。